影响生物利用度的因素是
A. 药物的化学稳定性
B. 药物在胃肠道中的分解
C. 肝脏的首过作用
D. 制剂处方组成
E. 非线性特征药物

正确答案：B、C、D、E。药物在胃肠道中的分解；肝脏的首过作用；制剂处方组成；非线性特征药物

解析：本题考查影响生物利用度的因素。生物利用度是指药物被吸收进入血液循环的速度与程度。药物在胃肠道中的分解（B对）、肝脏的首过作用（C对）、某些药物的非线性特征（E对）、制剂的处方（D对）均能影响生物利用度。药物的化学稳定性与生物利用度无关（A错）。